某男，50岁。体胖，患胸痹5年，时而心痛，痰多胸闷，苔白腻，证属痰浊闭阴，胸阳不振。日前因饮食不洁，又患胃肠气滞、泻痢里急后重，治当通阳散结、行气导滞，宜选用的药是
A. 薤白
B. 甘松
C. 沉香
D. 香附
E. 川棟子

正确答案：A。薤白

解析：本题考查的是薤白的功效。患胸痹5年，时而心痛，痰多胸闷，苔白腻，证属痰浊闭阴，胸阳不振。日前因饮食不洁，又患胃肠气滞、泻痢里急后重，治当通阳散结、行气导滞，宜选用的药是薤白（A对）。薤白：【功效】通阳散结，行气导滞。甘松（B错）：【功效】行气止痛，开郁醒脾。沉香（C错）：【功效】行气止痛，温中止呕，温肾纳气。香附（D错）：【功效】疏肝理气，调经止痛。川楝子（E错）：【功效】行气止痛，杀虫，疗癣。